麻疹恢复期，皮肤可见
A. 无色素斑痕，有糠麸样细微脱屑
B. 无色素斑痕，可见脱皮
C. 有色素斑痕，可见脱皮
D. 有色素斑痕，可见糠麸样细微脱屑
E. 有色素斑痕，无脱屑

正确答案：D。有色素斑痕，可见糠麸样细微脱屑

解析：麻疹恢复期，皮肤可见有色素斑痕，可见糠麸样细微脱屑。是真皮和黏膜下层的毛细血管发炎，血管内皮细胞充血、水肿、增殖及浆液渗出所致（D对）。